小儿患丹痧，常见
A. 舌起粗大红刺
B. 舌体肿硬麻木
C. 舌苔色红
D. 舌苔色黑
E. 舌苔花剥

正确答案：A。舌起粗大红刺

解析：猩红热为感受痧毒疫疠之邪之病，痧毒上攻舌体，则见舌起粗大红刺，状如草莓（A对）。舌体肿大，板硬麻木由心脾积热，火热循经上行所致（B错）。舌苔色红多见于温热病（C错）。舌苔色黑可见于因进食橄榄、乌梅、铁剂等后（D错）。舌苔花剥多为胃之气阴不足所致（E错）。